服药期可饮酒（包括中药药酒），可能导致双硫仑样反应的头孢菌素有
A. 头孢拉定
B. 头孢他啶
C. 头孢呋辛
D. 头孢哌酮
E. 头孢曲松

正确答案：D、E。头孢哌酮；头孢曲松

解析：本题考查可导致双硫仑样反应的头孢菌素。头孢哌酮（D对）、头孢曲松（E对）服用期间饮酒可导致双硫仑样反应。头孢哌酮存在与双硫仑分子结构类似的甲硫四氮唑活性基团，头孢曲松含甲硫三嗪侧链，饮酒后，可抑制乙醛脱氢酶活性，乙醛代谢受阻，在体内蓄积，引起双硫仑样反应。